牙齿萌出的时间超前于正常萌出的时间，且萌出的牙齿的牙根发育不足根长的1/3，称为
A. 牙齿固连
B. 牙齿早萌
C. 乳牙迟萌
D. 乳牙早失
E. 异位萌出

正确答案：B。牙齿早萌

解析：早萌：牙齿早萌指牙齿萌出的时间超前于正常萌出的时间，而且萌出牙齿的牙根发育不足根长的1/3。掌握“乳牙滞留和乳牙早萌”知识点。